按照《药品不良反应监测管理办法（试行）》规定，个人发现药品引起的可疑不良反应，应向
A. 所在市级卫生行政部门报告
B. 所在省级卫生行政部门报告
C. 所在市级药品不良反应监测专业机构报告
D. 所在省级药品不良反应监测专业机构或药品监督管理部门报告
E. 所在市级药品监督管理部门报告

正确答案：C。所在市级药品不良反应监测专业机构报告

解析：本题考查不良反应。按照《药品不良反应监测管理办法（试行）》规定，个人发现药品引起的可疑不良反应，应向所在市级药品不良反应监测专业机构报告（C对）。《药品不良反应报告和监测管理办法》第二十三条规定：个人发现新的或者严重的药品不良反应，可以向经治医师报告，也可以向药品生产、经营企业或者当地的药品不良反应监测机构报告，必要时提供相关的病历资料。